垂体借漏斗连于
A. 背侧丘脑
B. 后丘脑
C. 下丘脑
D. 底丘脑
E. 上丘脑

正确答案：C。下丘脑

解析：神经垂体分为神经部和漏斗两部分，漏斗与下丘脑（C对）相连，包括漏斗柄和正中隆起；腺垂体的结节部围绕在漏斗周围。